根据Kennedy分类法，右上87651，左上1278缺失属于
A. 第一类第一亚类
B. 第一类第二亚类
C. 第二类第一亚类
D. 第二类第二亚类
E. 第三类第一亚类

正确答案：A。第一类第一亚类

解析：第一类：义齿鞍基在两侧基牙的远中，远中为游离端，即双侧游离端缺牙。第二类：义齿鞍基在一侧基牙的远中，远中为游离端，即单侧游离端缺牙。第三类：义齿鞍基在一侧，鞍基前后都有基牙。第四类：义齿鞍基位于基牙的前面，越过中线的前部缺牙，基牙在缺隙的远中。除第四类外，其他三类都有亚类，即除主要缺隙外尚有一个缺隙则为第一亚类，有两个缺隙为第二亚类，依此类推。若前后有缺牙，以最后部的缺隙为准。掌握“局部义齿类型，肯氏分类及模型观测”知识点。